有关视网膜的描述，错误的是
A. 外层为色素部
B. 外层内的视锥细胞有感强光的作用
C. 内外二层之间脱离称视网膜剥离
D. 内层含神经节细胞
E. 神经节细胞的轴突穿眼球后壁组成视神经

正确答案：B。外层内的视锥细胞有感强光的作用

解析：视网膜分两层，外层为色素部（层）（A对），内层为神经层，内含有感强光作用的视锥细胞（B错，为本题正确答案）和神经节细胞（D对）。内外两层之间有一潜在性的间隙，内外二层之间脱离称视网膜剥离（C对）。神经节细胞的轴突穿眼球后壁组成视神经（E对）。（本题B选项的“外层”有歧义。若理解为视网膜的外层，则B选项有误；若理解为视网膜内层的外层，则各选项都对。）